男，48岁，间断性腹痛4年，加重4小时，腹痛多于进食后1小时发生，可自行缓解，未诊治。4小时前进食后突发剧烈疼痛，迅速波及全腹。查体：T36.8，P92次/分，R18，BP：160/80mmHg。查体：全腹反跳痛，肌紧张，有局部压痛。该病的治疗方法
A. 迷走神经切断术
B. 全胃切除术
C. 穿孔修补术
D. 胃大部切除术
E. 抗酸+补液

正确答案：D。胃大部切除术

解析：中年男性患者，胃溃疡穿孔1小时，全腹症状逐渐加重，最佳的治疗方法是常规胃大切（D对）。对于溃疡穿孔不超过24小时、腹腔污染不重的患者，可选择手术治疗，胃大部切除术可一次性解决穿孔和溃疡两个问题，故常作为首选治疗方法。患者症状有加重趋势，故不宜选择非手术治疗（A错）。小于＜8h，胃大切（未水肿，范围不大）。不切还会反复出血/癌病。 大于＞8h，穿孔修补（已经水肿，切了缝不起），修修补补，择期手术（C错）。高选择性迷走神经切断术（E错）主要用于治疗十二指溃疡，不适用于急性穿孔的患者。